Ph染色体阳性细胞减少甚或转阴
A. 骨髓移植
B. Ara‐C
C. 白细胞单采
D. 羟基脲
E. 干扰素

正确答案：B。Ara‐C

解析：小剂量Ara-C，不仅可控制病情发展，且可使Ph染色体阳性细胞减少甚或转阴（B对）。骨髓移植和白细胞单采显然不会使Ph染色体阳性细胞减少甚或转阴（AC错）。干扰素是通过直接抑制DNA多聚酶活性和干扰素调节因子的基因表达，从而影响自杀因子介导的凋亡（E错）。羟基脲（HU）为周期特异性抑制DNA合成药物（D错）。